新斯的明最强的药理作用是
A. 兴奋骨骼肌
B. 兴奋胃肠，膀胱平滑肌
C. 抑制心脏，减慢心率
D. 缩小瞳孔
E. 促进腺体分泌

正确答案：A。兴奋骨骼肌

解析：新斯的明是常用的AChE药（乙酰胆碱酯酶抑制药），可抑制AChE活性，导致ACh在突触后膜不能被胆碱酯酶分解，而发挥完全拟胆碱作用，即通过ACh兴奋M、N胆碱受体；此外，ACh尚能直接激动骨骼肌运动终板上的NM受体，对骨骼肌兴奋作用较强（A对），兴奋胃肠平滑肌的作用其次（B错），对腺体（E错）、眼（D错）、心血管（C错）及支气管平滑肌作用弱。